健康维护计划的制定原则不包括
A. 健康为导向
B. 个人积极参与
C. 普适性
D. 综合利用
E. 动态性

正确答案：C。普适性

解析：健康维护计划制定要依据病人的年龄、性别以及具体的危险因素等而计划进行的一系列干预措施。是一种个体化的健康维护计划，而非普适性（C错，为本题正确答案）。个体化健康维护计划的制定要遵循以下几个原则：①健康为导向的原则（A对）、②个性化的原则、③综合性利用的原则（D对）、④动态性原则（E对）⑤个人积极参与原则（B对）。